下列哪个体位最适宜同时取头、面、胸、腹部腧穴
A. 俯伏坐位
B. 俯卧位
C. 侧卧位
D. 仰卧位
E. 侧伏坐位

正确答案：D。仰卧位

解析：仰卧位（D对）适宜同时取头、面、胸、腹部腧穴。俯伏坐位（A错）适宜于取头项背部的腧穴时选用。俯卧位（B错）适宜于取头、项、脊背、腰骶部腧穴和下肢后侧及上肢部分腧穴时选用。侧卧位（C错）适宜于取身体侧面少阳经腧穴及上下肢部分腧穴时选用。侧伏坐位（E错）适宜于取侧头部、面颊及耳前后部位腧穴时选用。